缝合面颈部皮肤进针时，针尖与皮肤的关系是
A. 针尖与皮肤呈30°角
B. 针尖与皮肤呈45°角
C. 皮肤切口两侧进针间距大于皮下间距
D. 皮肤切口两侧进针间距等于或略小于皮下间距
E. 以上说法均不正确

正确答案：D。皮肤切口两侧进针间距等于或略小于皮下间距

解析：本题考查缝合。缝合面颈部皮肤进针时，针尖与皮肤的关系是皮肤切口两侧进针间距等于或略小于皮下间距（D对）。缝合面颈部皮肤进针时，针尖与皮肤垂直，并使皮肤切口两侧进针间距等于或略小于皮下间距才可达到满意效果。